喹诺酮类药物的临床应用包括
A. 呼吸系统感染
B. 泌尿生殖道感染
C. 肠道感染与伤寒
D. 脑膜炎奈瑟菌
E. 以上说法均正确

正确答案：E。以上说法均正确

解析：喹诺酮类药物的临床应用：①泌尿生殖道感染；②呼吸系统感染；③肠道感染与伤寒；④氟喹诺酮类对脑膜炎奈瑟菌具有强大的杀菌作用。掌握“喹诺酮类”知识点。